存在于抗原分子表面的，决定抗原特异性的特殊的化学基团称为
A. 表位
B. 异嗜性抗原
C. 抗原结合价
D. 类属抗原
E. Forssman抗原

正确答案：A。表位